静脉滴注硫酸镁可用于
A. 镇静、抗惊厥
B. 预防心绞痛
C. 抗心律失常
D. 阻滞麻醉
E. 导泻

正确答案：A。镇静、抗惊厥

解析：本题考查药物剂型的重要性。剂型可改变药物的作用性质：如硫酸镁口服剂型用作泻下药，但5%注射液静脉滴注，能抑制大脑中枢神经，具有镇静、抗惊厥（A对）作用。